属单轴关节
A. 肩关节
B. 桡尺近侧关节
C. 髋关节
D. 寰枕关节
E. 拇指腕掌关节

正确答案：B。桡尺近侧关节

解析：单轴关节包括两种形式，其中一种为车轴关节，如寰枢正中关节和桡尺近侧关节等（B对）。肩关节、髋关节属于球窝关节（AC错）。寰枕关节属于椭圆关节（D错）。拇指腕掌关节属于鞍状关节（E错）。